宜选用塞来昔布治疗的疾病是
A. 骨关节炎
B. 痛风
C. 胃溃疡
D. 支气管哮喘
E. 肾绞痛

正确答案：A。骨关节炎

解析：本题考查塞来昔布。塞来昔布为选择性COX-2抑制剂，临床用于缓解骨关节炎（A对）、类风湿性关节炎等；抗急性痛风（B错）关节炎可用秋水仙碱；胃溃疡（C错）可用奥美拉唑；支气管哮喘（D错）可用吸入性糖皮质激素；肾绞痛（E错）首选解痉类药物，如消旋山莨菪碱等。